meta分析中主要统计分析包括
A. 对各个独立的研究结果进行异质性检验，并根据检验结果选择适当模型进行加权合并各个研究的统计量
B. 计算各个独立研究的效应大小后按照Mental-Haenszel法进行合并分析
C. 对各个独立研究结果进行异质性检验和计算失安全数
D. 计算各个独立研究的效应大小和合并后的综合效应
E. 对各个独立研究结果进行异质性检验和Mental-Haenszel分层分析

正确答案：A。对各个独立的研究结果进行异质性检验，并根据检验结果选择适当模型进行加权合并各个研究的统计量

解析：本题考查meta分析的相关内容。meta分析中主要统计分析包括对各个独立的研究结果进行异质性检验，并根据检验结果选择适当模型进行加权合并各个研究的统计量（A对BCDE错）。